为预防临床可察知的功能损害所需营养素的量是
A. 生存需要量
B. 膳食营养素参考摄入量
C. 储备需要量
D. 预防明显的临床缺乏症的需要量
E. 基本需要量

正确答案：E。基本需要量

解析：本题考查基本需要量。基本需要量（E对ABCD错）是指为预防临床可察知的功能损害所需要的营养素量，满足这种需要，机体能够正常生长和繁育，但机体组织内很少或没有该营养素储备，如果短期内膳食供给不足就可能造成缺乏。